《希波克拉底誓言》的内容不涵盖以下哪一点
A. 为病家保密
B. 强调医生的品德修养
C. 尊重同道
D. 要有好的仪表和作用
E. 为病家谋利益

正确答案：D。要有好的仪表和作用